主治肾虚湿热带下的方剂首选
A. 二妙散
B. 易黄汤
C. 完带汤
D. 参苓白术散
E. 龙胆泻肝汤

正确答案：B。易黄汤

解析：主治肾虚湿热带下的方剂，当具备补肾、清热祛湿、止带之功。易黄汤中重用炒山药、炒芡实共为君药，补脾益肾，固涩止带；臣以白果收涩止带；佐以少量黄柏苦寒入肾，清热燥湿，车前子甘寒，清热利湿。诸药共奏补肾，清热，祛湿，止带之功，以主治肾虚湿热带下（B对）。二妙散功用为清热燥湿，主治湿热下注证（A错）。完带汤功用为补脾疏肝，化湿止带，主治脾虚肝郁，湿浊带下（C错）。参苓白术散功用为益气健脾，渗湿止泻，主治脾虚湿盛证（D错）。龙胆泻肝汤功用为清泻肝胆实火，清利肝经湿热（E错）。